角色功能受限不包括
A. 角色活动的数量受限
B. 角色紧张
C. 角色冲突
D. 角色活动的种类受限
E. 角色活动的范围受限

正确答案：E。角色活动的范围受限

解析：本题考查角色功能受限的内容。角色功能受限包括主要角色活动的种类（D对）和数量受限（A对）、角色紧张（B对）和角色冲突（C对）等。角色活动的范围受限（E错，为本题正确答案）不是角色功能受限的内容。